羊水内肺表面活性物质迅速增加的时间是
A. 25周
B. 28周
C. 30周
D. 35周
E. 40周

正确答案：D。35周

解析：肺泡表面活性物质由Ⅱ型肺泡上皮产生，妊娠28周（B错）时出现于羊水内，但量少，直至35周（D对）时迅速增加，作用为降低肺泡表面张力，使肺泡不易萎陷，有利于肺泡内保存气体。